下列哪项不是肛门直肠周围脓肿切开挂线疗法的适应证
A. 坐骨直肠窝脓肿
B. 高位肌间脓肿
C. 骨盆直肠间隙脓肿
D. 肛门前低位脓肿
E. 直肠黏膜下脓肿

正确答案：E。直肠黏膜下脓肿

解析：挂线法主要用于坐骨直肠病脓肿、肌间脓肿，骨合直肠间隙脓肿和脓腔通过肛器直肠环者，直肠黏膜下脓肿表浅，可以采用切开引流术即可（E错，为本题正确答案）。